主要用于精神分裂症的治疗药物有
A. 丙米嗪
B. 氟西汀
C. 氯丙嗪
D. 氟哌利多
E. 利培酮

正确答案：C、D、E。氯丙嗪；氟哌利多；利培酮